下列有关流感的治疗，错误的是
A. 加强支持治疗
B. 发病初期即应抗病毒治疗
C. 奥司他韦成人每日剂量为150mg
D. 甲乙型流感均可用神经氨酸酶抑制剂
E. 使用抗菌药物预防继发感染

正确答案：E。使用抗菌药物预防继发感染

解析：以一般及对症治疗为主，必要时给予抗流感病毒治疗。（一）一般治疗 休息，多饮水，清淡营养饮食，保持鼻咽及口腔清洁。密切观察病情变化，防止发生并发症（A对）。（二）对症治疗 酌情应用解热镇痛药、缓解鼻黏膜充血药物、止咳祛痰药物等。儿童忌用阿司匹林或含阿司匹林药物及其他水杨酸制剂，防止发生Reye综合征。（三）抗病毒治疗 早期（48小时内）给予抗流感病毒治疗可取得最佳疗效（B对）。现有离子通道M2阻滞剂和神经氨酸酶抑制剂两类。1.离子通道M2阻滞剂通过阻断M2蛋白而阻止病毒脱壳及其RNA的释放，干扰病毒进入细胞，使病毒早期复制被中断。主要有金刚烷胺和金刚乙胺，但目前甲型流感病毒毒株已对其耐药，临床上很少使用。金刚烷胺成人每日200mg，一次或分2次服用，疗程3～4日，应注意监测神经系统及消化道不良反应。2.神经氨酸酶抑制剂 阻止病毒由被感染细胞释放和入侵邻近细胞，减少病毒的播散及在体内的复制，对甲、乙型流感病毒均有作用（D对）。此类品种目前有奥司他韦、扎那米韦、帕拉米韦及那尼纳米韦等。奥司他韦13岁以上患者每次75mg，每日2次口服，连服5日（C对）；13岁以下儿童按体重给药；1岁以下儿童不推荐使用。扎那米韦可用于12岁以上的患者，每日2次，间隔约12小时，每次10mg（分两次吸人，一次5mg），连用5日。帕拉米韦成人患者300mg，静脉滴注，一次给药（E错，为本题正确答案）。